与肺炎链球菌在鼻咽部和支气管黏膜的定植、繁殖及扩散有关的是
A. 荚膜
B. 自溶酶
C. 神经氨酸酶
D. 溶血素
E. 胆汁溶菌酶

正确答案：C。神经氨酸酶

解析：神经氨酸酶：与肺炎链球菌在鼻咽部和支气管黏膜的定植、繁殖及扩散有关。掌握“链球菌属”知识点。